为了解病毒性肝炎在某地区的分布情况，研究者于2019年7月进行抽样调查部分结果如下共调查10000，男6000人女4000人，发现患者1000人，女性300人（乙肝200例，丙肝50例，其他50例），调查还发现在600例乙肝患者中有300例是2019年新发。该地区女性乙肝患病率为
A. 200/10000
B. 350/1000
C. 300/1000
D. 200/4000
E. 无法计算

正确答案：D。200/4000

解析：女性乙肝患者200例，总人数为4000人。该地区女性乙肝患病率为200/4000（D对）。